影响胎儿和婴儿软骨发育不全，孕妇及哺乳妇女不宜用的药物是
A. 四环素类
B. 喹诺酮类
C. 磺胺类
D. 硝基呋喃类
E. ETMP

正确答案：B。喹诺酮类

解析：喹诺酮类（B对）抗菌药对胎儿和婴儿可引起软骨组织损害，故不适用于儿童、孕妇、哺乳期妇女；药物的C3羧基以及C4羰基与软骨组织中的镁离子形成络合物，并沉积于关节软骨，造成局部镁离子缺乏而致软骨损）。四环素类（A错）药物经血液到达新形成的牙齿组织可造成恒齿永久性棕色色素沉着。长期使用磺胺类（C错）可能抑制骨髓造血功能。硝基呋喃类和ETMP均无软骨损害（DE错）。